具有屈肘并旋后作用的是
A. 旋前圆肌、旋前方肌
B. 肱二头肌
C. 旋前圆肌、肱二头肌
D. 旋前圆肌、旋后肌
E. 以上都不对

正确答案：B。肱二头肌

解析：旋前圆肌（ACD错）使前臂旋前，屈肘。旋前方肌（A错）使前臂旋前。肱二头肌（B对）屈肘并旋后，协助屈肩关节。旋后肌（D错）使前臂旋后。